医疗机构从业人员的职业价值目标是
A. 大医精诚
B. 以患者为中心
C. 人道行医
D. 为人民健康服务
E. 救死扶伤

正确答案：D。为人民健康服务

解析：社会公益思想的广泛传播和深入影响，要求医务人员将病人的利益与社会利益、近期利益与长远利益结合起来，将社会群体和人类后代的生命健康作为自己工作的重要目标。医疗机构从业人员的职业价值目标是为人民健康服务（D对），救死扶伤是医疗机构从业人员的职业道德手段（E错）。